因胆固醇的合成有昼夜节律，夜间合成增加，故使用抑制胆固醇合成药物辛伐他汀时，推荐的服药时间是
A. 中午
B. 清晨
C. 上午
D. 下午
E. 临睡前

正确答案：E。临睡前

解析：本题考查辛伐他汀使用时间。夜间给予他汀类降脂药降低血清胆固醇的作用更强，推荐临睡前（E对）给药；清晨服用的药物如糖皮质激素等，可减少对下丘脑-垂体-肾上腺皮质系统的反馈抑制，避免导致肾上腺皮质功能下降；餐前服用药物如胃黏膜保护药可以充分地黏附于胃壁，形成一层保护屏障；餐中服用的药物如降糖药和非甾体抗炎药等可减少对胃肠道的刺激；餐后服用的药物如西咪替丁等胃溃疡药物，可利用餐后胃排空延迟来延长药物的作用时间；催眠药和服用后易出现嗜睡反应的药可以在睡前服用。